对医疗事故技术鉴定委员会所作的结论不服的，病员及其家属和医疗单位在接到结论之日起，可以申请重新鉴定的期限要求是：
A. 24小时内
B. 48小时内
C. 15日内
D. 30日内
E. 45日内

正确答案：C。15日内

解析：当事人对首次医疗事故技术鉴定结论不服的，可以自收到首次鉴定结论之日起15日内（C对）向医疗机构所在地卫生行政部门提出再次鉴定的申请。